女，36岁。慢性肾衰竭4年。1周来水肿加重、伴恶心、呕吐、胸痛、呼吸困难。查体：T38.1℃，BP180/100mmHg，心前区可闻及心膜摩擦音。血红蛋白63g/L，血尿素氮28.6mmol/L，肌酐870.9umol/L。目前治疗错误的是
A. 血液透析
B. 利尿
C. 抗感染
D. 快速补充血容量
E. 控制血压

正确答案：D。快速补充血容量

解析：中年女性患者，既往有慢性肾衰竭病史4年。1周来水肿加重（水、钠潴留引起），伴恶心、呕吐（伴发胃肠道症状，是慢性肾衰竭最早最突出的症状）。查体：BP180/100mmHg（正常为90～130/60～90mmHg，提示血压升高），心前区可闻及心包摩擦音（提示合并心包积液），胸痛、呼吸困难（心包积液最典型的表现，心包积液在慢性肾衰竭患者中常见，其原因多与尿毒症毒素蓄积、低蛋白血症、心力衰竭等有关）。T38.1℃（正常为36～37℃，考虑合并感染）。血红蛋白63g/L（正常为110～150g/L，考虑肾性贫血），血尿素氮28.6mmol/L（正常值为3.2～7.1mmol/L，提示有氮质血症），肌酐870.9μmol/L（正常值为88.4～176.8μmol/L，提示血肌酐升高），根据我国慢性肾衰竭的分期方法判断（血肌酐≥707μmol/L为尿毒症阶段），患者处于尿毒症期。尿毒症期患者，病情较重，已出现水钠潴留、高血压及氮质血症等代谢紊乱，应在控制液体入量（D错，为本题正确答案）的前提下，进行利尿（B对）、控制血压（E对）、血液透析（A对）治疗。尿毒症期患者合并感染，应进行抗感染（C对）治疗。